交感神经兴奋时可引起
A. 瞳孔缩小
B. 逼尿肌收缩
C. 消化道括约肌舒张
D. 孕妇的子宫平滑肌收缩
E. 支气管平滑肌收缩

正确答案：D。孕妇的子宫平滑肌收缩

解析：大多数交感节后纤维释放的递质是去甲肾上腺素（除支配汗腺和骨骼肌血管的交感节后纤维释放乙酰胆碱外），交感神经系统的活动与各器官上去甲肾上腺素受体的分布有关。交感神经兴奋时，作用于虹膜辐射状肌（瞳孔开大肌）的α1受体，使虹膜辐射状肌收缩，瞳孔扩大（A错）。作用于膀胱逼尿肌的β₂受体使逼尿肌舒张（B错）。作用于消化道括约肌的α1受体使消化道括约肌收缩（C错）。作用于支气管平滑肌的β₂受体使支气管平滑肌舒张（E错）。作用于妊娠子宫的α1受体使妊娠子宫收缩（D对）。